某男，70岁，患糖尿病10年，长期服用西药降糖药，血糖稳定。今日听人介绍，又自行加服了中成药消渴丸。2日后，出现低血糖反应，遂去医院就诊。医师分析出现低血糖反应的原因，与过量服用降糖药有关。并告知患者，在其所服的消渴丸中因含有降糖类化学药，会与原用的降糖药产生叠加作用，消渴丸中所含的化学药成分是
A. 二甲双胍
B. 格列苯脲
C. 阿卡波糖
D. 罗格列酮
E. 瑞格列奈

正确答案：B。格列苯脲

解析：本题考查的是含西药组分的中成药。消渴丸中所含的化学药成分是格列苯脲（B对）。消渴丸：功能滋肾养阴，益气生精。用于气血两虚型消渴病。症见多饮、多尿、多食、消瘦、体倦乏力、眠差、腰痛型糖尿病见上述证候者。含西药成分格列本脲。